单纯性二尖瓣狭窄时，首先发生代偿性肥大和扩张的是
A. 左心室
B. 右心室
C. 左心房
D. 左房左室同时发生
E. 左房右心室同时发生

正确答案：C。左心房

解析：单纯性二尖瓣狭窄早期由于左心房的血液流入左心室受阻，而导致左心房压升高，严重狭窄时左心房压需高达20～25mmHg才能使血流通过狭窄的瓣口，使左心室充盈并维持正常的心排出量，因此左心房（C对）会出现代偿性肥厚和扩张。单纯二尖瓣狭窄少见左心室代偿性肥大和扩张（AD错）。随着疾病的发展，左心房压增高引起的肺静脉压力增高导致肺动脉压力增高，而肺动脉高压增加右心室负荷，引起右心室肥厚和扩张，出现右心衰竭。因此右心室肥厚和扩张一般在左心房之后（BE错）。